绒癌最常见的转移部位是
A. 阴道
B. 宫颈
C. 肝脏
D. 脑部
E. 肺部

正确答案：E。肺部

解析：绒癌极易经血道转移，最常见的转移部位是肺（E对），也可转移至阴道（A错）、宫颈（B错）、肝脏（C错）和脑部（D错）等，但均较少见。